属于子宫破裂的临床表现，正确的是
A. 病理缩复环不再升高
B. 产妇突感子宫收缩停止
C. 产妇疼痛难忍
D. 胎体触不清
E. 阴道多量鲜血流出

正确答案：B。产妇突感子宫收缩停止

解析：产妇疼痛难忍（P218）（C错）为先兆子宫破裂的临床表现。子宫破裂时，产妇突感下腹一阵撕裂样剧痛，子宫收缩骤然停止（B对），腹痛稍缓和后，待羊水、血液进入腹腔，又出现全腹持续性疼痛；腹壁下可清楚扪及胎体（D错）；阴道检查可有鲜血流出，但量通常不多（E错）。病理性缩复环见于先兆子宫破裂，子宫破裂时病理性缩复环消失（A错）。